关于产褥期处理及保健的说法正确的是
A. 少量口服抗生素，预防乳头皲裂
B. 会阴部可用稀释的高锰酸钾或新洁尔灭冲洗
C. 必须退奶时，可口服大剂量孕激素
D. 产后访视应在产后42天开始
E. 产后24小时内，每3～4小时哺乳一次

正确答案：B。会阴部可用稀释的高锰酸钾或新洁尔灭冲洗

解析：本题考查产褥期处理及保健。会阴部可用稀释的高锰酸钾或新洁尔灭冲洗（B对）。预防乳头皲裂，可于哺乳前湿热敷3～5分钟，挤出少许乳汁，使乳晕变软，以利新生儿含吮乳头和大部分乳晕；哺乳后挤少许乳汁涂在乳头和乳晕上，短暂暴露和干燥，也可涂抗生素软膏或10%复方苯甲酸酊（A错）。必须退奶时，不推荐用雌激素或溴隐亭退奶（C错）。产妇出院后，由社区医疗保健人员在产妇出院后3日、产后14日和产后28日分别做3次产后访视，了解产妇及新生儿健康状况（D错）。于产后半小时内开始哺乳，哺乳的时间及频率取决于新生儿的需要及乳母感到奶胀的情况（E错）。